女性，72岁，摔倒后左髋疼痛伴不能活动3小时，查体见左下肢缩短，外旋畸形，X线显示左侧股骨头下骨皮质不连续，断端部分吻合，最佳治疗方法
A. 髋关节置换术
B. 对症治疗，应用非甾体药物
C. 切开复位固定
D. 卧床骨牵引
E. 卧床休息

正确答案：A。髋关节置换术

解析：患者72岁（>65岁），有摔伤史，左下肢缩短、外旋畸形，考虑其最可能的诊断是左股骨颈骨折。X线显示左侧股骨头下骨皮质不连续（股骨颈头下型骨折），应选择人工髋关节置换术（A对）。对症治疗，应用非甾体药物（B错）卧床骨牵引（D错）卧床休息（E错）均为非手术治疗措施。切开复位固定（C错）适合手法复位失败，或固定不可靠，或青壮年的陈旧骨折不愈合。